根分叉病变的主要病因是
A. 咬合创伤
B. 根柱过长
C. 龋病
D. 磨牙症
E. 菌斑

正确答案：E。菌斑

解析：根分叉病变是指牙周炎的病变波及多根牙的根分叉区，在该处出现牙周袋、附着丧失和牙槽骨破坏，可发生于任何类型的牙周炎。下颌第一磨牙的发生率最高，上颌前磨牙最低。发生率随年龄增大而上升。本病是牙周炎向深部发展的一个阶段，菌斑微生物是其主要病因。只是由于根分叉区一旦暴露，该处的菌斑控制和牙石的清除十分困难，使病变加速或加重发展，不易控制。掌握“根分叉病变”知识点。